以下关于颞下颌关节紊乱综合征的叙述哪项是错误的
A. 好发于青壮年，是一组疾病的总称
B. 关节内微小创伤与精神心理因素是本病的两个主要致病因素
C. 本病有自限性，一般不会发生关节强直
D. 三个主要临床症状是：下颌运动异常、自发痛及关节弹响和杂音
E. 以保守治疗为主

正确答案：D。三个主要临床症状是：下颌运动异常、自发痛及关节弹响和杂音

解析：本题考查颞下颌关节紊乱综合征的一般特点。疼痛是其三大主要症状之一，但一般无自发痛（D错，为本题的正确答案），主要表现为开口和咀嚼运动时关节区或关节周围肌群的疼痛。颞下颌关节紊乱综合征好发于青壮年，是一组疾病的总称（A对）。其发病机制目前尚未清楚，但多数学者认为关节内微小创伤与精神心理因素是本病的两个主要致病因素（B对），此外还包括颌因素、免疫因素、关节负荷过重等原因。本病虽然病期一般较长，并且常反复发作，但是本病有自限性，一般不会发生关节强直（C对），预后良好。本病的治疗以保守治疗为主（E对），采用对症治疗和消除或减弱致病因素相结合的综合治疗。